患者，男，63岁。体胖，有高血压和糖尿病史。饱餐后突感心前区闷痛，伴有气短痰多，纳呆恶心，含服硝酸甘油2分钟疼痛缓解。舌苔浊腻，脉滑。心电图示V₃～V₆导联T波倒置，心肌酶谱正常。应首先考虑的诊断是
A. 冠心病心绞痛心血瘀阻证
B. 冠心病心绞痛痰浊内阻证
C. 心肌梗死气滞血瘀证
D. 心肌梗死寒凝心脉证
E. 冠心病心绞痛气虚血瘀证

正确答案：B。冠心病心绞痛痰浊内阻证

解析：痰浊盘踞，胸阳失展，气机痹阻，脉络阻滞，故见饱餐后突感心前区闷痛，伴有气短痰多；痰浊困脾，脾气不运，故见纳呆恶心；舌苔浊腻，脉滑均为痰浊之侯，应属于痰浊痹阻（B对）。心肌梗死（CD错）的疼痛部位与心绞痛相仿，但性质更剧烈，持续可达数小时，含服硝酸甘油多不能缓解。心血瘀阻（A错）的表现为胸痛较剧，如刺如绞，入夜加重，伴有胸闷，日久不愈，或因暴怒而致心胸剧痛，舌质紫暗或有瘀斑，舌下络脉青紫迂曲。气虚血瘀证（E错）的特点为胸痛隐隐，时轻时重，遇劳则发，神疲乏力，气短懒言，心悸自汗。